以下杂质检查的条件是：重金属
A. 在盐酸酸性条件下检查
B. 在硝酸酸性条件下检查
C. 在醋酸盐缓冲液（pH3.5）中检查
D. 在硫酸酸性条件下检查
E. 在磷酸盐缓冲液（pH6.8）中检查

正确答案：C。在醋酸盐缓冲液（pH3.5）中检查

解析：本题考查重金属杂质检查的条件。重金属杂质检查的条件是在醋酸盐缓冲液（pH3.5）中检查（C对）。硫代乙酰胺法：硫代乙酰胺在弱酸性（pH为3.5的乙酸盐缓冲液）条件下水解，产生硫化氢与微量重金属离子，生成黄色到棕黑色的硫化物均匀混悬液，与一定量的标准铅溶液经同法处理后所呈的颜色比较，判定供试品中的重金属是否符合限量规定。